正常人尿中可以偶见的管型是
A. 红细胞管型
B. 白细胞管型
C. 上皮细胞管型
D. 透明管型
E. 蜡样管型

正确答案：D。透明管型

解析：正常人尿中可以偶见的管型是透明管型（D对），透明管型由T-H糖蛋白、清蛋白和氯化物构成，为无色透明、内部结构均匀的圆柱状体，两端钝圆，偶尔含有少量颗粒，透明管型还可见于肾病综合征、慢性肾炎等患者尿液中。红细胞管型（A错）临床意义与血尿相似，见于泌尿系炎症、结石、肿瘤、结核、外伤等患者尿液中。白细胞管型（B错）常见于肾盂肾炎、间质性肾炎等。上皮细胞管型（C错）在肾小管损伤时出现。蜡样管型（E错）提示有严重的肾小管变性坏死，且预后不良。